输注新鲜冰冻血浆的主要目的是
A. 补充血浆蛋白
B. 补充营养
C. 提高免疫力
D. 纠正凝血功能异常
E. 补充血容量

正确答案：D。纠正凝血功能异常

解析：新鲜冰冻血浆（FFP）中含有全部凝血因子和血浆蛋白，主要用于纠正止血功能异常（D对）。补充血浆蛋白（A错）的主要方式为输注白蛋白。补充营养（B错）需要输注的是碳水化合物、氨基酸制剂、脂肪乳制剂及电解质、维生素等多种营养素的混合物。提高免疫力（C错）的主要方式为输注丙种球蛋白。补充血容量（E错）的主要方式为静脉补充晶体液。